宜整片或整丸吞服，严禁嚼碎和研碎服用的剂型是
A. 泡腾片剂
B. 舌下片
C. 激素类气雾剂
D. 缓控释制剂
E. 透皮贴剂

正确答案：D。缓控释制剂

解析：本题考查各种剂型的正确使用。缓、控释制剂（D对）除另有规定外，一般应整片或整丸吞服，严禁嚼碎和研碎服用。供口服的泡腾片（A错）一般宜用100～150ml凉开水或温水浸泡，可迅速崩解和释放药物，应待完全溶解或气泡消失后再饮用，严禁直接服用或口含。舌下片（B错）舌下含服时间一般控制在5min。激素类气雾剂（C错）使用后宜用温水漱口。透皮贴剂（E错）应用时需贴敷于干净的皮肤，经皮给药。